7天的停药期，其中包括漏服的天数，然后再开始继续服用下一周期的药物。如果妇女漏服了药物，而且在随后的第一个正常停药间隔期未出现撤退性出血，则应考虑妊娠的可能性。【对发生胃肠道紊乱者的建议】部分注明如下内容：如果发生重度胃肠道紊乱，则吸收可能不完全，应采取额外的避孕措施。如果服用药物后3～4小时内发生呕吐，可以采用“漏服药的处理”参见【用法用量】的建议。如果妇女不想改变正常的服药计划，她必须从另一盒中取出药物补服。假如某女士在2017年4月15日20：00开始服用新一周期的药物，在4月25日20：00发现4月24日应服的药片漏服，之前均正确服药。在这种情况下，患者对漏服药的处理，正确的是
A. 在常规时间20：00服用4月25日的药片，不用补服4月24日的药片
B. 尽快同时服用两片药，然后在常规时间继续服药，在以后的7天内要加用屏障避孕法
C. 不再继续服用此周期药物，经过一个7天的停药期，再开始继续服用下一周期的药物
D. 尽快同时服用两片药，然后在常规时间继续服药，不需要使用额外的避孕措施
E. 尽快同时服用两片药，然后在常规时间继续服药，这盒药服完后立即开始服用下一盒药，即两盒药之间没有停药期

正确答案：D。尽快同时服用两片药，然后在常规时间继续服药，不需要使用额外的避孕措施

解析：本题考查复方激素避孕药的使用。4月15日开始服用新一周期的药物，4月25日则为第二周。材料中明确“使用者应该在想起来时尽快服用漏服的药片，即使这意味着同时服用两片药。然后在常规的时间继续服药。假若使用者在第1片漏服药的前7天内均正确服药，则不需要使用额外的避孕措施”。患者之前均正确服药，所以患者无需额外的避孕措施（D对）。